鉴别青霉素钠中钠盐的方法是
A. 焰色反应法
B. 干燥失重测定法
C. 分子排阻色谱法
D. 红外分光光度法
E. 反相高效液相色谱法

正确答案：A。焰色反应法

解析：本题考查钠盐的鉴别。《中国药典》附录“一般鉴别试验”中钠盐和钾盐的鉴别应用焰色反应法（A对）。